资源严重减少的野生药材是
A. 羚羊角
B. 黄芩
C. 天麻
D. 丹参
E. 甘草

正确答案：B。黄芩

解析：本题考查野生药材物种。资源严重减少的野生药材是黄芩（B对）。三级保护野生药材物种系指资源严重减少的主要常用野生药材物种。三级保护药材名称：川贝母（4个品种）、伊贝母（2个品种）、刺五加、黄芩、天冬、猪苓、龙胆（4个品种）、防风、远志（2个品种）、胡黄连、肉苁蓉等。羚羊角（A错）为一级保护野生药材物种。甘草（E错）为二级保护野生药材物种。天麻（C错）和丹参（D错）未列入国家重点保护的野生药材目录。